抑制细菌蛋白质合成
A. 头孢米诺
B. 磺胺甲噁唑甲氧苄啶
C. 利福喷丁
D. 头孢吡肟
E. 依替米星

正确答案：E。依替米星

解析：本题考查依米替星的作用机制。依替米星（E对）属于氨基糖苷类抗菌药，作用机制主要是抑制细菌蛋白质的合成。磺胺甲噁唑甲氧苄啶（B错）抑制细菌二氢叶酸的合成。头孢米诺（A错）属于其它β-内酰胺类抗菌药物。利福喷丁（C错）可抑制细菌核酸合成。头孢吡肟（D错）通过抑制细菌细胞壁合成抑菌。